女，65岁。急性前壁心肌梗死后2个月复诊。日常活动感气短，有时心悸，无黑朦、晕厥。超声心动图示左室前壁节段性运动减弱，室壁瘤形成，左室扩大，LVEF30％。心电图示窦性心律，不完全性右束支传导阻滞，QRS时限0.10s。追问病史：心梗发作时曾因室颤行电除颤一次。就诊后建议该患者植入心脏转复除颤器，其依据是
A. LVEF30％
B. 不完全性右束支传导阻滞
C. 室壁瘤形成
D. 曾发生过室颤
E. 仍有心肌缺血

正确答案：A。LVEF30％

解析：患者老年女性，陈旧性前壁心肌梗死2月，曾有心梗发作后非持续性室速。日常活动感气短，有时心悸，无黑朦、晕厥（提示为NYHAⅡ级）。超声心动图示左心室室壁瘤形成，LVEF30%（明显降低，正常＞80%）。心电图示不完全性右束支传导阻滞，QRS时限正常。结合患者急性心梗病史、临床表现及影像学检查，最可能的诊断为1.左心衰竭；2.左室室壁瘤；3.非持续性室速。植入型心律转复除颤器 （ICD）是一种终止致命性心律失常的多功能、多程控参数的电子装置，有抗心动过缓、抗心动过速、低能电复律及高能电除颤等多重功能。该患者陈旧前壁心梗，LEVF30%（A对），远小于正常，心肌收缩功能显著降低，血流动力学不稳定，快速型心律失常如室颤，器质性心动过缓均易发生，安装ICD为最佳治疗措施。患者室壁瘤形成（C错），不完全性右束支传导阻滞（B错），仍有心肌缺血（E错）对室颤的发生发展均有促进作用，但非疾病发生的决定因素，因此不是装配ICD的主要依据。